下腹部手术拆线时间一般为术后
A. 7～9日
B. 4～5日
C. 13～14日
D. 6～7日
E. 10～12日

正确答案：D。6～7日

解析：缝线的拆除时间，可根据切口部位、局部血液供应情况、病人年龄、营养状况等来决定。一般头、面、颈部在术后4～5日（B错）拆线，下腹部、会阴部在术后6～7日（D对）拆线，胸部、上腹部、背部、臀部手术7～9日（A错）拆线，四肢手术10～12日（E错）拆线（近关节处可适当延长），减张缝线14日拆线（C错）。